梁某的姐姐因患子宫脱垂在某医院接受手术治疗。术后第3天突然死亡。梁某对死因提出质疑，要求复印其姐姐的全部病例资料。医院工作人员依据《医疗事故处理条例》提供了其有权复印的病例资料。以下病例资料中可复印的是
A. 会诊意见
B. 上级医师查房记录
C. 死亡病例讨论记录
D. 病程记录
E. 住院志

正确答案：E。住院志

解析：依据《医疗事故处理条例》以下病例资料中可复印的是住院志（E对），患者可复印客观性病例资料，以上选项中只有住院志属于客观性的，会诊意见（A错）、上级医师查房记录（B错）、死亡病例讨论记录（C错）、病程记录（D错）都属于主观性的病例资料。